一般所说的生物地球化学性疾病主要是指
A. 自然疫源性疾病
B. 地球环境因素引起的疾病
C. 环境污染所致公害病
D. 遗传性疾病
E. 区域内的传染病

正确答案：B。地球环境因素引起的疾病

解析：本题考查生物地球化学性疾病。一般所说的生物地球化学性疾病主要是指地球环境因素引起的疾病（B对）。自然疫源性疾病（A错）为以野生动物为传染源传播的疾病，如鼠疫、钩端螺旋体病、肾综合征出血热、森林脑炎等。环境污染所致公害病（C错）指由人类活动造成严重环境污染引起公害所发生的地区性疾病， 如与大气污染有关的慢性呼吸道疾病、由含汞废水引起的水俣病、由含镉废水引起的痛痛病等。遗传性疾病（D错）为遗传因素作为唯一或主要病因的疾病。区域内的传染病（E错）是指由病原微生物，如朊粒、病毒、衣原体、立克次体、支原体、细菌、真菌、螺旋体和寄生虫，如原虫、蠕虫、医学昆虫感染人体后产生的有传染性、在一定条件下可造成流行的疾病。